具有行气宽中，调经止痛功效的药物是
A. 柿蒂
B. 木香
C. 香附
D. 乌药
E. 薤白

正确答案：C。香附

解析：该题考查香附的功效。香附味辛、微苦、微甘，性平，具有疏肝解郁，调经止痛，理气调中的功效，主入肝经气分，善散肝气之郁结，为疏肝解郁，行气止痛之要药，此外还能入脾经，有宽中、消食下气的作用（C对）。